男婴，5天。出生时正常，不吃、不哭、体温不升1天，嗜睡。查体：反应差，皮肤轻度黄疸并有花纹呼吸急促。该婴的可能诊断是
A. 新生儿黄疸
B. 新生儿溶血病
C. 新生儿败血症
D. 新生儿窒息
E. 新生儿缺氧缺血性脑病

正确答案：C。新生儿败血症

解析：患儿出生时正常，未见特异性表现，但有花纹提示有存在休克，加之皮肤有轻度黄疸，考虑新生儿败血症（C对）。新生儿黄疸（P111）（A错）约有85%的足月儿和绝大多数早产儿在新生儿期均有暂时性总胆红素升高。新生儿溶血症（P116）（B错）有黄疸、贫血和肝脾肿大的临床表现。新生儿窒息（P95）（D错）早期胎动增加，晚期胎动减少。新生儿缺氧缺血性脑病（P100）（E错）无黄疸，多表现为神经肌力变化。